不是朊粒主要特点的是
A. 引起人和动物中枢神经退化性病变
B. 不含有RNA
C. 是蛋白酶抗性蛋白
D. 仅含DNA
E. 具有传染性

正确答案：D。仅含DNA